用一种筛选宫颈癌的试验，在1000名已证实患宫颈癌和1000名未患宫颈癌的妇女中，筛检结果为：患宫颈癌组中有800名阳性，未患癌组有200名阳性。试验的灵敏度是
A. 0.8
B. 0.2
C. 0.6
D. 0.4
E. 0.3

正确答案：A。0.8